通过严格控制条件，研究行为或活动条件与心理的因果关系，在医学心理学的研究方法中属于
A. 调查法
B. 临床观察法
C. 个案法
D. 实验法
E. 心理测验法

正确答案：D。实验法